牙周手术时，两牙之间有较大缝隙或龈乳头较宽时，应采用的缝合方法
A. 牙间间断缝合
B. 间断缝合
C. 悬吊缝合
D. 锚式缝合
E. 褥式缝合

正确答案：E。褥式缝合

解析：水平褥式缝合：适用于两牙之间有较大缝隙或龈乳头较宽时，为使龈瓣能更好地贴合骨面，可做水平褥式缝合。此法可与连续悬吊缝合联合应用。掌握“慢性牙周炎的治疗原则、程序及方法”知识点。